加入二氯氧化锆甲醇溶液形成黄色络合物，再加入枸橼酸后黄色不消退的是
A. 二氢黄酮
B. 5-羟基黄酮
C. 黄酮醇
D. 7-羟基黄酮
E. 异黄酮

正确答案：C。黄酮醇